以下哪项不是卫生法的渊源？
A. 宪法
B. 卫生地方性法规
C. 卫生行政通告
D. 卫生部门规章
E. 卫生国际条约

正确答案：C。卫生行政通告

解析：卫生法的渊源有：宪法（A对），法律，行政法规，地方性法规（B对），自治条例、单行条例，规章（D对），卫生标准，法律解释，卫生国际条约（E对）（C错，为本题正确答案）。